女，34岁，血压210／130mmHg，下列哪项可以作为肾血管性高血压的主要诊断依据
A. 无高血压家族史
B. 右上腹连续性高调血管杂音
C. 近期发生的高血压
D. 血浆肾素水平增高
E. 氮质血症

正确答案：B。右上腹连续性高调血管杂音

解析：肾血管性高血压是继发性高血压的第二位原因，系由于单侧或双侧肾动脉主支管腔狭窄，导致肾脏血流灌注降低而引起高血压。肾动脉狭窄的表现包括腹部血管杂音、自发性低血钾和肾功能进行性减退（实用内科学P1513）。因此右上腹连续性高调血管杂音（B对）可以作为肾血管性高血压的主要诊断依据。无高血压家族史（A错）和近期发生的高血压（C错）多提示为继发性高血压，但继发性高血压有多种情况，故这两者不可以作为肾血管性高血压的主要诊断依据。高血压伴血浆肾素水平增高（D错）提示肾小球旁细胞肿瘤、Wilms瘤及卵巢肿瘤等疾病（P706）。高血压伴氮质血症（E错）提示肾实质性高血压病（P259）。